长期大量应用头孢菌素类抗菌药物的患者，需注意适当补充
A. 维生素A和维生素D
B. 维生素B和维生素K
C. 维生素C和叶酸
D. 维生素E和叶酸
E. 维生素B₁₂和叶酸

正确答案：B。维生素B和维生素K

解析：本题考查药物的联合应用。长期服用头孢菌素的患者宜补充维生素K、复方维生素B（B对）。液状石蜡可引起维生素A、D、K的缺乏（A错）。长期服用抗凝血药导致维生素C的缺乏（C错）。维生素A等缺乏时可引起维生素E的缺乏。口服避孕药可能导致维生素C、叶酸、维生素B₁₂的缺乏（DE错）。